心动周期中主动脉压最低值
A. 收缩压
B. 舒张压
C. 脉压
D. 体循环平均充盈压
E. 中心静脉压

正确答案：B。舒张压

解析：动脉血压通常指主动脉压，舒张压是心动周期中动脉血压最低时的值，因此心动周期中主动脉压最低值是舒张压（B对）。收缩压（A错）是心动周期中主动脉压的最高值（P122）。脉压（C错）是指收缩压和舒张压的差值（P122）。体循环平均充盈压（D错）表示循环系统中血液的充盈程度（P121）。中心静脉压（E错）指右心房和胸腔内大静脉血压（P125）。